根据《化妆品卫生监督条例》，关于化妆品管理的说法，正确的是
A. 非特殊用途化妆品是指用于育发、健美、脱毛、祛斑的化妆品
B. 生产化妆品需取得化妆品卫生许可证和化妆品生产许可证
C. 首次进口特殊用途化妆品，应经国务院药品监督管理部门批准
D. 首次进口非特殊用途化妆品，应取得省级化妆品监督管理部门颁发的批准文号

正确答案：C。首次进口特殊用途化妆品，应经国务院药品监督管理部门批准

解析：本题考查化妆品管理。根据《化妆品卫生监督条例》，关于化妆品管理的说法，正确的是首次进口特殊用途化妆品，应经国务院药品监督管理部门批准（C对）。化妆品的界定和分类：化妆品，是指以涂擦、喷洒或其他类似的方式，施用于皮肤、毛发、指甲、口唇等人体表面，以清洁、保护、美化、修饰为目的的日用化学工业产品。国务院药品监督管理部门负责全国化妆品监督管理工作，国务院有关部门在各自职责范围内负责与化妆品有关的监督管理工作。县级以上地方人民政府负责药品监督管理的部门负责本行政区域的化妆品监督管理工作。县级以上地方人民政府有关部门在各自职责范围内负责与化妆品有关的监督管理工作。国家按照风险程度对化妆品、化妆品原料实行分类管理。化妆品分为特殊化妆品、普通化妆品。国家对特殊化妆品实行注册管理，对普通化妆品实行备案管理。用于染发、烫发、祛斑美白、防晒、仿脱发的化妆品以及宣称新功效的化妆品为特殊化妆品（A错）。特殊化妆品以外的化妆品为普通化妆品。对于进口化妆品，应当提交境外生产企业生产质量管理的有关证明材料和产品在生产国（地区）或原产国（地区）上市销售的证明文件，专为中国市场生产、不能提交产品在生产国（地区）或者原产国（地区）上市销售的证明文件的，应当提交产品面向中国消费者销售的证明文件，并提供相关的研究和实验数据。化妆品生产经营管理方式和批准文号管理：特殊化妆品经国务院药品监督管理部门注册后方可生产、进口。国产普通化妆品应当在上市销售前向备案人所在地省、自治区、直辖市人民政府药品监督管理部门备案。进口普通化妆品应当在进口前向国务院药品监督管理部门备案（D错）。国家对化妆品生产实行许可制度。生产化妆品需依法持有省级化妆品监督管理部门颁发的化妆品生产许可证，未取得《化妆品生产许可证》的化妆品生产企业，不得从事化妆品生产。化妆品生产许可证有效期五年。自2017年1月1日起，统一启用《化妆品生产许可证》。化妆品生产企业持有的原《全国工业产品生产许可证》和《化妆品生产企业卫生许可证》自动作废（B错）。